患者女性，28岁。停经45天，阵发腹痛伴多量阴道流血1天。妇科检查：子宫6周妊娠大小，宫口开，有血液不断流出，处理首选的是
A. 立即抗感染
B. 按摩子宫
C. 静点缩宫素待妊娠物自然排出
D. 尽早清宫
E. 输血

正确答案：D。尽早清宫

解析：本题考查自然流产。难免流产：指流产不可避免。在先兆流产基础上，阴道流血量增多，阵发性下腹痛加剧，或出现阴道流液（胎膜破裂）。妇科检查宫颈口已扩张，有时可见胚胎组织或胎囊堵塞于宫颈口内，子宫大小与停经周数相符或略小。流产不可避免，尽早清宫（D对）。